女，35岁。尿频、尿痛伴肉眼血尿1天。既往体健。查体无异常。尿亚硝酸盐阳性，尿沉渣镜检红、白细胞满视野。抗生素疗程一般为
A. 14天
B. 5天
C. 7天
D. 10天
E. 3天

正确答案：E。3天

解析：青年女性患者，突发尿频、尿痛伴肉眼血尿，尿亚硝酸盐阳性（提示可能有尿路感染），尿沉渣镜检红白细胞满视野（尿路感染的表现），结合患者病史、临床表现和相关检查，该患者最可能的诊断为急性细菌性膀胱炎。急性膀胱炎可选用复方磺胺甲噁唑、头孢菌素类、喹诺酮类药物，该患者未出现并发症，应采用3日疗法（E对），疗效与7日疗程相似且副作用少、费用低。